临床常用的对抗HIV抗体进行初筛的检查方法是
A. 免疫荧光法
B. 放射免疫测定
C. 免疫PCR
D. 免疫印迹法
E. ELISA法

正确答案：E。ELISA法